根据社区卫生服务站基本设施设置指导标准，业务用房使用面积不应少于多少平方米
A. 60
B. 70
C. 80
D. 90
E. 100

正确答案：A。60